慢性肾盂肾炎的肾脏肉眼观察不同于慢性肾小球肾炎的是
A. 体积缩小
B. 肾脏内小动脉硬化
C. 表面呈颗粒状
D. 颜色苍白
E. 有不规则的凹陷疤痕

正确答案：E。有不规则的凹陷疤痕